卵巢黏液性囊腺瘤的病理学特征是
A. 单个囊腺泡，内上皮为单层扁平状上皮
B. 内层为多层高柱状上皮
C. 大小不一的囊腔，充满富含糖蛋白的粘稠液体
D. 囊腔和间质可见多个砂粒体
E. 可见明显异型性细胞

正确答案：C。大小不一的囊腔，充满富含糖蛋白的粘稠液体

解析：在卵巢黏液性囊腺瘤中，它的病理学特征有：肉眼可见肿瘤表面光滑，由多个大小不一的囊腔组成，腔内充满富于糖蛋白的黏稠液体，较少形成乳头（C对）。镜下，良性黏液性腺瘤的痰腔被覆单层高柱状上皮（AB错），核在基底部，核的上部充满黏液，无纤毛，和胃及小肠的上皮相似，交界性黏液性肿瘤镜下特征和交界性浆液性肿瘤相似。黏液性癌上皮细胞明显异型（E错），形成复杂的腺体和乳头结构，可有出芽、搭桥及实性巢状区，如能确认有间质明显破坏性浸润，则可诊断为癌。浆液性癌最主要的特征是有明显的癌细胞破坏性间质浸润，其乳头分支多而复杂，树枝状分布，常可见砂粒体（D错）。